“寒极生热，热极生寒”说明了阴阳之间的哪种关系
A. 相互转化
B. 相互交感
C. 对立制约
D. 互根互用
E. 消长平衡

正确答案：A。相互转化

解析：“寒极生热，热极生寒”是指寒或者热发展到了极限或顶点，具备了促进转化的条件，从而向其相反的方向转化为热或者寒，是事物阴阳属性在一定条件下向其对立面转化，即阴阳的相互转化（A对）。相互交感是指阴阳二气如题中的寒与热，在运动中处于相互感应，即不断地相互影响、相互作用的过程，而未发生转化（B错）。阴阳的对立制约是相互对立的阴阳双方，大多存在着相互抑制和约束的特性。阴阳对立制约体现了对立事物或现象的调控作用，从而维持事物发展的动态平衡（C错）。阴阳互根互用是指事物或现象中相互对立的阴阳两个方面，具有相互依存、相互为用的关系。阴阳互根互用是说阴和阳任何一方都不能脱离对方而单独存在，即没有寒也就无所谓热，没有热也就无所谓寒，寒依存于热，热依存于寒，并且可以相互资生、促进和助长（D错）。阴阳消长平衡是指事物或现象对立制约、互根互用的阴阳两个方面不是处于静止状态，而是处于运动变化之中。阴阳消长是在对立制约、互根互用基础上变现出的量变过程，未出现寒极生热、热极生寒的质变（E错）。